下列哪种脉搏提示主动脉瓣关闭不全
A. 交替脉
B. 奇脉
C. 水冲脉
D. 短绌脉
E. 脱落脉

正确答案：C。水冲脉

解析：主动脉瓣关闭不全患者左心室收缩压升高，舒张期时由于主动脉瓣关闭不全，主动脉血反流入左心室，使血压迅速降低，脉压差增大，脉搏骤起骤落，形成水冲脉（C对）。交替脉（九版诊断学P160）（A错）系节律规则而强弱交替的脉搏。一般认为系左室收缩力强弱交替所致，为左室心力衰竭的重要体征之一。奇脉（九版诊断学P160）（B错）是指吸气时脉搏明显减弱或消失，系左室搏血量减少所致，常见于右心衰竭、心包积液、缩窄性心包炎及严重哮喘等疾病。短绌脉（D错）即脉搏短绌，指在同一单位时间内，脉率少于心率，多见于心房颤动的病人。脱落脉（E错）是正常脉搏后出现一个长时间的间歇，常提示患者出现Ⅱ度房室传导阻滞。